轧钢车间工人能接触到的职业性有害因素应不包括
A. 电离辐射
B. 热辐射
C. 粉尘
D. 高温
E. 有害气体

正确答案：A。电离辐射

解析：本题考查高温、强热辐射作业场所。高温（D对）、强热辐射（B对）生产场所的气象特点是气温高、热辐射强度大，而相对湿度较低，形成干热环境，轧钢车间是明显的高温、强热辐射环境。其主要特点是高温，存在热辐射，高温环境下会产生大量粉尘（C对）和有害气体（E对）。电离辐射（A错，为本题正确答案）主要包括X射线，γ射线等，与题意不符。